HCV球状颗粒的直径为
A. 10～20nm
B. 20～30nm
C. 30～40nm
D. 40～60nm
E. 60～80nm

正确答案：D。40～60nm

解析：HCV为直径40～60nm的球状颗粒，有包膜和表面刺突结构。掌握“丙型、丁型、戊型肝炎病毒”知识点。